下列关于肾的描述，何者错误
A. 肾锥体的尖端伸向肾窦合并成为肾乳头
B. 肾锥体的数目与肾乳头的总数一致
C. 皮质深入肾锥体之间的部分称为肾柱
D. 肾小盏的数目较肾乳头少
E. 肾盂、肾大盏、肾小盏位于肾窦内

正确答案：B。肾锥体的数目与肾乳头的总数一致

解析：2~3个肾锥体尖端合并成肾乳头（A对），所以肾锥体数目多于肾乳头（B错为本题正确答案）。肾乳头有7~12个，肾小盏有7~8个，所以肾小盏的数目较肾乳头少（D对）。皮质深入肾锥体之间的部分称为肾柱（C对），在肾窦内，肾小盏汇合称肾大盏，肾大盏汇合称肾盂（E对）。